慢性咽炎者需应用口含片，使用时应注意
A. 应把药片置于舌根部，并尽量贴近咽部
B. 为避免过敏反应发生，含后应及时漱口
C. 口服后30分钟内不宜进食或饮水
D. 含服时不宜咀嚼或吞咽
E. 发生过敏、皮疹、瘙痒等反应，及时停药

正确答案：A、C、D、E。应把药片置于舌根部，并尽量贴近咽部；口服后30分钟内不宜进食或饮水；含服时不宜咀嚼或吞咽；发生过敏、皮疹、瘙痒等反应，及时停药

解析：本题考查口含片的正确使用。慢性咽炎者需应用口含片，使用时应把药片置于舌根部，并尽量贴近咽部（A对）。不能咀嚼或吞咽药物（D对）。口服后30min内不宜吃东西或饮水（C对B错）。对于服用任何药物，出现不良反应需及时停药（E对）。